以下哪个不属于关节的基本结构
A. 关节囊
B. 关节腔
C. 关节唇
D. 关节头
E. 关节窝

正确答案：C。关节唇

解析：关节的基本结构有关节囊（A对）、关节面、关节腔（B对）。关节面中，凸者为关节头（D对），凹者为关节窝（E对）。关节辅助结构有韧带、关节盘、关节唇（C错，为本题正确答案）、滑膜襞和滑膜囊。